女，60岁。反复咳嗽咳痰25年，心悸气促下肢间歇水肿3年，病情加重伴畏寒发热1周入院。体检：T38度，呼吸急促，口唇发绀，双肺叩诊过清音，中下肺闻及湿啰音，心率110次/分，心律齐，无杂音，双下肢重度水肿。主要治疗措施应为
A. 祛痰与止咳
B. 解痉与平喘
C. 低浓度持续吸氧
D. 给予利尿剂和强心剂
E. 控制感染与改善功能

正确答案：E。控制感染与改善功能

解析：该患者反复咳嗽咳痰25年（为慢阻肺的典型表现），心悸气促下肢间歇水肿3年，双肺叩诊过清音，考虑诊断为慢阻肺（COPD）。现出现病情加重伴畏寒发热，双下肢重度水肿，考虑诊断为由COPD引起的肺源性心脏病肺、心功能失代偿期（出现右心衰竭的体征如下肢重度水肿，表明已经处于肺源性心脏病肺、心功能失代偿期）。肺、心功能失代偿期的治疗原则为积极控制感染，通畅呼吸道，改善呼吸功能（E对）。祛痰与止咳（A错）解痉与平喘（B错）、低浓度持续吸氧（C错）为为一般的对症治疗，不是主要的治疗措施。慢性肺心病患者一般在积极控制感染、改善呼吸功能后，心衰便能得到改善，且慢性肺心病的患者由于慢性缺氧及感染，对洋地黄类药物的耐受性低，易致中毒，出现心律失常，不需常规使用利尿剂和强心剂（D错）。